某人进食午餐后回家，1小时左右出现头疼、头晕、恶心、呕吐、视物模糊、瞳孔缩小如针尖大、呼吸困难等症状，到卫生所就医，初步诊断是中毒。根据症状，可考虑为
A. 有机磷农药中毒
B. 亚硝酸盐中毒
C. 赤霉病麦中毒
D. 发芽马铃薯中毒
E. 有毒蜂蜜中毒

正确答案：A。有机磷农药中毒